罗拉匹坦静脉注射乳剂中作乳化剂的是
A. 卵磷脂
B. 碳酸氢钠
C. 半胱氨酸
D. 聚乙二醇
E. 聚氧乙烯蓖麻油

正确答案：A。卵磷脂

解析：本题考查乳化剂的种类。乳化剂常用的有卵磷脂（A对）、豆磷脂及普朗尼克F-68等。一般以卵磷脂为好，由于卵磷脂极不稳定，一般现购现用。